可在新生儿期进行筛查的疾病是
A. 先天性甲状腺减低，苯丙酮尿症
B. 癫痫
C. 21-三体综合征
D. 黏多糖病
E. 先天性巨结肠

正确答案：A。先天性甲状腺减低，苯丙酮尿症

解析：先天性甲状腺减低、苯丙酮尿症（A对）可在新生儿期进行筛查。目前根据国家“母婴保健法”的规定，新生儿疾病筛查正在全国逐步推广，除了先天性甲状腺功能减低症、苯丙酮尿症（A对）新生儿筛查外，有的地区还开展了G-6-DP缺乏症，先天性肾上腺皮质增生症筛查。癫痫（B错）只有在患儿出现症状是才有机会进行检查和诊断。21-三体综合征（C错）一般是做产前筛查，以便及时做出相应措施。黏多糖病（D错）一般在生育前进行遗传咨询，有条件的可做产前基因诊断，而非新生儿期筛查。先天性巨结肠（E错）在新生儿期即可根据相关临床表现做出诊断并进行治疗。